某医师欲比较A、B两种降压药的降压效果，随机抽取了高血压病人各100名，由测量值算得两组病人服药前后舒张压下降值的平均数分别为0.45kPa和0.34kPa。作两大样本均数比较的u检验u=6.306，P＜0.01，结论是
A. 两样本均数不同
B. 两种降压药物的降压效果相差很大
C. A药的临床疗效比B药好
D. 统计学上认为两总体均数不相等
E. 两种降压药物的降压效果差别是由偶然误差产生的，所以无统计意义

正确答案：D。统计学上认为两总体均数不相等